某患者残根需要拔除，X线片显示其上6腭侧根与上颌窦底影像重叠，可根据以下哪种征象判断牙根是否位于上颌窦内
A. 根尖周是否密度减低
B. 牙周膜及骨硬板是否连续
C. 上颌窦底是否突入牙根之间
D. 上颌窦是否过大
E. 垂直角度是否过大

正确答案：B。牙周膜及骨硬板是否连续

解析：本题考查硬骨板的影像学表现。某患者残根需要拔除，X线片显示其上6腭侧根与上颌窦底影像重叠，可根据以下牙周膜及骨硬板是否连续（B对）征象判断牙根是否位于上颌窦内。如果牙周膜及骨硬板连续，则说明牙根没有位于上颌窦内，相反如果牙周膜及骨硬板没有连续性，就说明是牙根位于上颌窦内。